以下哪项不属于WHO对膀胱尿路上皮癌的分型
A. 乳头状瘤
B. Ⅰ级分化良好，属低度恶性
C. 乳头状低度恶性倾向的尿路上皮肿瘤
D. 低级别乳头状尿路上皮癌
E. 高级别乳头状尿路上皮癌

正确答案：B。Ⅰ级分化良好，属低度恶性